接种免疫球蛋白是一种
A. 人工主动免疫
B. 人工被动免疫
C. 被动主动免疫
D. 使用类毒素制剂的免疫
E. 使用基因重组疫苗的免疫

正确答案：B。人工被动免疫